下列各项，不属于不伤害原则真正意义的是
A. 培养为患者高度负责的精神
B. 保护患者健康和生命的理念
C. 消除任何医疗伤害
D. 避免使患者受到不应有的医疗伤害
E. 正确对待医疗伤害现象

正确答案：C。消除任何医疗伤害

解析：不属于不伤害原则真正意义的是消除任何医疗伤害。不伤害原则具有双重效应，该行为基于善的动机和目的，带来了明显的诊治作用和善效果的直接效应。但同时，也带来了一些不可避免的伤害和副作用，即恶效果的间接效应。例如引产救母、必要截肢、隔离治疗等（C错，为本题正确答案）。